下颌牙槽嵴吸收的方向
A. 向下向内
B. 向下向外
C. 向上向内
D. 向上向外
E. 向上

正确答案：B。向下向外

解析：本题考查牙列缺失后的病因及影响。下颌牙槽嵴内侧骨板较外侧骨板疏松，内侧骨板吸收较外侧骨板多，牙槽嵴吸收的方向为向下向外（B对）。